某男，72岁。腹泻肠鸣，脐腹作痛，泻后则安，畏寒喜暖，腰膝酸软，舌淡苔白，脉沉细，治宜选用的中成药有
A. 四神丸
B. 固本益肠片
C. 香连丸
D. 参苓白术散
E. 涩肠止泻散

正确答案：A、B。四神丸；固本益肠片

解析：本题考查的是泄泻的辨证论治。腹泻肠鸣，脐腹作痛，泻后则安，畏寒喜暖，腰膝酸软，舌淡苔白，脉沉细，治宜选用的中成药有四神丸（A对）与固本益肠丸（B对）。泄泻是以排便次数增多，粪质稀溏或完谷不化，甚至泻出如水样为主症的疾病。西医学的急性肠炎、肠易激综合征、炎症性肠病等有上述表现者，可参考此内容辨证论治。（一）寒湿内盛证：【症状】泄泻清稀，甚则如水样，脘闷食少，腹痛肠鸣，或兼见外感风寒，恶寒，发热，头痛，肢体酸痛。舌苔白或白腻，脉濡缓。【中成药应用】常用中成药有藿香正气水、五苓散。（二）湿热伤中证：【症状】泄泻腹痛，泻下急迫，势如水注，或泻而不爽，粪色黄褐，气味臭秽，肛门灼热，烦热口渴，小便短黄。舌质红，苔黄腻，脉滑数或濡数。【中成药应用】常用中成药有肠康片、香连片（C错）、痢必灵片（糖衣片）、泻痢消胶囊、连蒲双清片、白蒲黄片。（三）食滞肠胃证：【症状】腹痛肠鸣，泻下粪便臭如败卵，泻后痛减，泻下伴有不消化食物，脘腹胀满，嗳腐吞酸，不思饮食。舌淡红，苔垢浊或厚腻，脉滑实。【中成药应用】常用中成药有加味保和丸、枳实导滞丸、和中理脾丸。（四）肝气乘脾证：【症状】腹痛而泻，腹中雷鸣，攻窜作痛，矢气频作，每因抑郁恼怒或情绪紧张之时而泻，素有胸胁胀闷，嗳气食少。舌质淡，脉弦。【中成药应用】常用中成药有痛泻宁颗粒、养胃颗粒。（五）脾胃虚弱证：【症状】大便时溏时泻，迁延反复，食少，食后脘闷不舒，稍进油腻食物，则大便次数增多，面色萎黄，神疲倦怠。舌质淡，苔白，脉细弱。【中成药应用】常用中成药有人参健脾丸（大蜜丸）、补中益气丸（水丸）、参苓健脾胃颗粒。（六）肾阳虚衰证：【症状】黎明前脐腹作痛，肠鸣即泻，泻后则安，完谷不化，腹部喜暖，形寒肢冷，腰膝酸软。舌淡苔白，脉沉细。【中成药应用】常用中成药有四神丸、桂附理中丸、固本益肠片、肠胃宁片。中成药应用为涩肠止泻散（E错）的病证，2022年考试指南未明确说明。